关于难治性肾病综合征的治疗，不予考虑的药物是
A. 甲泼尼龙
B. 环孢素A
C. 环磷酰胺
D. 硫唑嘌呤
E. 氟尿嘧啶

正确答案：E。氟尿嘧啶

解析：难治性肾病综合征是指在激素足量治疗8～12周后病情仍未缓解的肾病综合征，该病症经久不愈可诱发严重感染、急性肾功能衰竭、血栓栓塞综合征等致命的并发症，最终发展成为慢性肾衰竭，甚至威胁生命。治疗上首先应明确难治性肾病是真难治还是假难治，真难治是患者的病理类型对治疗不敏感，如膜性肾病等；假难治是指在去除一些致病因素后，肾病综合征对激素变为敏感或自行缓解。对于真难治性肾病综合征，针对机体免疫机能亢进的患者，传统的方法是选用大剂量激素或免疫抑制剂，如大剂量甲泼尼龙（A对）或大剂量环磷酰胺（C对）等，还可用硫唑嘌呤（D对）、环孢素A（B对）、他克莫司等免疫抑制剂很大程度上提高了难治性肾病综合征的缓解率。而氟尿嘧啶（E错，为本题正确答案）是抗代谢药物，可干扰DNA的合成，静脉用药后，广泛分布于体液中，被活跃分裂的组织或肿瘤所优先摄取，从而达到抗癌的目的。